原发性闭经是指
A. 女性年满18岁，月经尚未来潮
B. 女性年满16岁，月经尚未来潮
C. 女性年满16岁，二性征已发育，但月经尚未来潮
D. 女性年龄超过15岁，二性征已发育，或年龄超过13岁，二性征仍未发育，且无月经来潮者
E. 女性年龄超过18岁，二性征已发育，或年龄超过16岁，二性征仍未发育，且无月经来潮者

正确答案：D。女性年龄超过15岁，二性征已发育，或年龄超过13岁，二性征仍未发育，且无月经来潮者

解析：本题考查原发性闭经的相关概念。原发性闭经指年龄超过15岁、第二性征已发育、月经还未来潮者；或年龄超过13岁，第二性征未发育者（D对ABCE错）。